弱碱性有机药物含量测定宜选用
A. 非水溶液滴定法
B. 配位滴定法
C. 铈量法
D. 碘量法
E. 亚硝酸钠滴定法

正确答案：A。非水溶液滴定法

解析：本题考查非水溶液滴定法。弱碱性有机药物含量测定宜选用非水溶液滴定法（A对）。非水溶液滴定法分为非水碱量法和非水酸量法，非水碱量法用于测定有机弱碱及其盐类药物。配位滴定法（B错）是以配位反应为基础的一种滴定分析法。可用于对金属离子进行测定。铈量法（C错）以四价铈离子溶液为标准溶液的氧化还原滴定方法。碘量法（D错）用于滴定还原性强或氧化性强的药物。亚硝酸钠滴定法（E错）用于含芳伯氨基或潜在的芳伯氨基的药物滴定。